胃食管反流病的主要发病机制不包括
A. 夜间胃酸分泌过多
B. 下食管括约肌压力降低
C. 异常的下食管括约肌一过性松弛
D. 胃排空异常
E. 食管酸廓清能力下降

正确答案：A。夜间胃酸分泌过多

解析：胃食管反流病是由于多种因素造成LES（食管下括约肌）功能障碍为主的胃食管动力障碍性疾病，反流症状在餐后1小时最明显，夜间胃酸分泌过多（A错，为本题正确答案）不会导致胃食管反流，而是导致十二指肠溃疡。食管下括约肌压力降低（B对），胃内容物更容易通过LES反流至食管。异常的食管下括约肌一过性松弛（C对）时，胃内容物反流入食管。胃排空异常（D对）时，胃内压力增加，使胃内容物更容易反流入食管。食管酸廓清能力下降（E对），食管不能快速有效将反流入食管的胃内容物清除，胃内容物高酸，腐蚀食管。